地榆槐角丸既能疏风润燥，又能
A. 凉血息风
B. 凉血祛湿
C. 凉血活血
D. 凉血消溃
E. 凉血泻热

正确答案：E。凉血泻热

解析：本题考查的是地榆槐角丸的功能。地榆槐角丸既能疏风润燥，又能凉血泻热（E对）。地榆槐角丸：【功能】疏风凉血，泻热润燥。羚羊角：【功效】平肝息风，清肝明目，凉血（A错）解毒。紫草：【功效】凉血活血（C错），解毒透疹。功能为凉血祛湿（B错）或凉血消溃（D错）的中成药，2022年考试指南未明确说明。